下列除哪组外，均为治疗肝火目赤肿痛的药组
A. 夏枯草、密蒙花
B. 龙胆草、赤芍
C. 青葙子、决明子
D. 石决明、谷精草
E. 女贞子、枸杞子

正确答案：E。女贞子、枸杞子

解析：女贞子可用于治疗肝肾阴虚所致的目暗不明、视力减退；枸杞子可用于肝肾阴虚或精亏血虚导致的两目干涩、内障目昏（E对）。夏枯草、密蒙花均具有清热泻火、明目的的功效，均可用于治疗肝火上炎所致的目赤肿痛（A错）。龙胆草、赤芍均具有清热泻火、明目的功效，均可用于治疗肝火上炎所致的目赤肿痛（B错）。青葙子、决明子均具有清肝泻火、明目退翳的功效，均可以治疗肝火上炎所致的目赤肿痛（C错）。 石决明、谷精草均具有清肝泻火、明目的功效，均具有治疗肝火上炎所致的目赤肿痛（D错）。